《医疗用毒性药品管理办法》规定，收购、经营、加工、使用毒性药品的单位必须建立健全的制度有
A. 保管制度
B. 验收制度
C. 储备制度
D. 领发制度
E. 核对制度

正确答案：A、B、D、E。保管制度；验收制度；领发制度；核对制度

解析：本题考查毒性药品的储存管理要求。《医疗用毒性药品管理办法》规定，收购、经营、加工、使用毒性药品的单位必须建立健全的制度有保管制度（A对）、验收制度（B对）、领发制度（D对）、核对制度（E对）。